在患者健康教育中，不属于人际传播方式的是
A. 举办讲座
B. 患者咨询
C. 观看录像
D. 医生指导
E. 患者间交流

正确答案：C。观看录像